药品作为特殊商品的特征包括
A. 生命关联性
B. 广泛使用性
C. 高质量性
D. 公共福利性
E. 高度的专业性

正确答案：A、C、D、E。生命关联性；高质量性；公共福利性；高度的专业性